属于青霉烷砜类的β-内酰胺类抗生素是
A. 氨曲南
B. 亚胺培南
C. 舒巴坦钠
D. 克拉维酸钾
E. 替莫西林

正确答案：C。舒巴坦钠

解析：本题考查青霉烷砜类的β-内酰胺类抗生素。属于青霉烷砜类的β-内酰胺类抗生素是舒巴坦钠（C对）。氨曲南（A错）为单环β-内酰胺类。亚胺培南（B错）为碳青霉烯类。克拉维酸钾（D错）属于氧青霉烷类。替莫西林（E错）半合成青霉素。